青霉素G钾制成粉针剂的目的是
A. 降低介电常数使注射液稳定
B. 防止药物水解
C. 防止药物氧化
D. 降低离子强度使药物稳定
E. 防止药物聚合

正确答案：B。防止药物水解

解析：本题考查药物制剂稳定化方法。青霉素G钾制成粉针剂的目的是防止药物水解（B对）。青霉素G钾催化水解苯巴比妥阴离子，故可以用介电常数低的溶剂降低药物分解速度，使注射液稳定（A错）。采用微囊化和包合技术，可防止药物因受环境中的氧气、湿度、水分、光线的影响而降解，从而增加其稳定性，如维生素A制成微囊后稳定性提高（C错）。在制剂处方中，往往加入电解质调节等渗，或加入盐防止氧化，加入缓冲剂调节pH，因而存在离子强度对降解速度的影响，青霉素G钾制成粉针剂并没有降低离子强度（D错）。药物聚合会使药物的稳定性降低而降低疗效，青霉素G钾制成粉针剂并不是以防止药物聚合为目的（E错）。